医学道德的基本原则不包括的是
A. 无伤原则
B. 行善原则
C. 公正原则
D. 尊重原则
E. 平等原则

正确答案：E。平等原则

解析：医学道德的基本原则不包括的是平等原则。医学道德的基本原则包括无伤原则（A对）、行善原则（B对）、公正原则（C对）、尊重原则（D对）。尊重原则要求医务人员尊重患者。欧美一般称为自主原则，即对自主的人及其自主性的尊重。知情同意、知情选择、要求保守秘密和隐私等，均是尊重患者的体现。广义上的尊重原则还包括医务人员尊重患者及其家属的人格。不伤害原则要求医务人员在诊治过程中，应尽量避免对患者造成生理上和心理上的伤害更不能人为有意地制造伤害。有利原则要求医务人员的诊治行为应该保护患者的权益、促进患者健康、增进其幸福。公正包括程序性质的公正、回报性质的公正和分配性质的公正等不同形式（E错，为本题正确答案）。